银汞合金充填后进行打磨抛光的目的是
A. 美观
B. 使边界清晰
C. 减少继发龋
D. 减少磨损对颌牙
E. 去除高点

正确答案：C。减少继发龋

解析：本题考查银汞合金充填后打磨抛光的目的。银汞合金充填后进行打磨抛光的目的是去除充填体表面不平整的缺陷，使表面变得光滑，从而不易被腐蚀和沉积菌斑，减少继发龋发生（C对）。雕刻成形的目的是达到美观（A错）、使边界清晰（B错）。调整咬合的目的是去除高点（E错）、减少磨损对颌牙（D错）。